男，43岁。肝炎肝硬化病史15年，反复少尿、腹胀1年，一周来腹痛伴低热。腹水常规：比重1.017，蛋白28g/L，细胞总数920×10⁶/L，白细胞800×10⁶/L，多形核细胞0.80。最可能的诊断是
A. 门静脉血栓形成
B. 结核性腹膜炎
C. 原发性肝癌
D. 自发性腹膜炎
E. 肝肾综合征

正确答案：D。自发性腹膜炎

解析：中年男性患者，有肝炎肝硬化病史15年，反复少尿、腹胀1年（提示有腹水），肝硬化患者出现腹水后容易导致自发性细菌性腹膜炎，一周来腹痛伴低热（细菌感染的表现）。腹水常规：比重1.017（漏出液低于1.018，渗出液高于1.018，提示为漏出液），蛋白28g/L（漏出液＜25g/L，渗出液＞30g/L，提示介于渗、漏出液之间），细胞总数920×10⁶/L（漏出液常＜100，渗出液常＞500，提示为渗出液），白细胞800×10⁶/L（漏出液常＜100×10⁶/L，渗出液常＞500×10⁶/L，提示为渗出液），多形核细胞0.80（提示细菌感染），该患者的腹水常规提示该患者的腹水为渗、漏出液之间且有细菌感染。综合该患者的病史和腹水常规，最可能的诊断为肝硬化并发自发性腹膜炎（D对）。肝硬化合并门静脉血栓形成（P409）（A错）常表现为剧烈腹痛、腹胀、血便、休克、短期内脾大、腹水迅速增加。结核性腹膜炎（P370）（B错）多见于中青年患者，有结核病史，长期不明原因发热，伴有腹壁柔韧感或腹部包块，腹水为渗出液，且以淋巴细胞为主。原发性肝癌（P416）（C错）常表现为右上腹痛，合并包块，血性腹水。肝肾综合征（P409）（E错）主要表现为少尿或无尿、氮质血症、血清肌酐升高等。